负荷试验可用于哪类营养素的营养状况评价
A. 蛋白质
B. 脂溶性维生素
C. 水溶性维生素
D. 微量元素
E. 脂肪

正确答案：C。水溶性维生素